脘胁胀痛，吞酸嘈杂，常见于
A. 肝火犯肺证
B. 心肝火旺证
C. 肝脾不调证
D. 肝胃不和证
E. 肝肾阴虚证

正确答案：D。肝胃不和证

解析：本题考查的是肝胃不和证的临床表现。脘胁胀痛，吞酸嘈杂，常见于肝胃不和证（D对）。肝胃不和证的临床表现，常见胸胁胀满，善太息，胃脘胀满作痛，嗳气吞酸，嘈杂或呕恶，苔薄黄，脉弦。肝火犯肺证（A错）的临床表现，常见胸胁窜痛，咳嗽阵作，甚则咯吐鲜血，性急善怒，烦热口苦，头眩目赤，舌质红，舌苔薄，脉弦数。肝脾不调证（C错）的临床表现，常见胸胁胀痛，善太息，腹部胀满，肠鸣，大便稀薄，矢气多，精神抑郁，性情急躁，食纳减少，舌苔白，脉弦数。肝郁气滞，故胸胁胀满、善太息、精神抑郁、性情急躁。肝肾阴虚证（E错）的临床表现，常见头晕目眩，耳鸣，胁痛，腰膝酸软，咽干，颧红，盗汗，五心烦热，男子或见遗精，女子或见月经不调，舌红无苔，脉细数。心肝火旺证（B错）的临床表现，2022年考试指南未明确说明。